下列腧穴中,有通乳作用的是
A. 少府
B. 少泽
C. 少冲
D. 少商
E. 少海

正确答案：B。少泽

解析：少泽为通乳要穴（B对）。少府主治心悸、胸痛等心胸病；阴痒，阴痛；痈疡（A错）。少冲主治心悸、心痛、癫狂等心及神志病证；热病；胸胁痛（C错）。少商主治咽喉肿痛、鼻衄、高热等肺系实热证；癫狂、昏迷（D错）。少海主治心痛、癔症等心病、神志病；肘臂挛痛，头项痛、瘰疬（E错）。